夜晚间的陆地温度比水面低，气流由陆地吹向水面，形成
A. 山风
B. 谷风
C. 海风
D. 陆风
E. 城市热岛

正确答案：D。陆风

解析：本题考查陆风。夜晚间的陆地温度比水面低，气流由陆地吹向水面，形成陆风（D对ABCE错）。